Th1细胞主要分泌的细胞因子
A. IL-1
B. IL-2
C. IL-3
D. IL-4
E. IL-5

正确答案：B。IL-2

解析：TH1细胞能分泌IL-2（B对）、IFN-γ和TNF-α的Th1细胞因子，通过促进CTL（细胞毒性T淋巴细胞）、NK细胞（自然杀伤细胞）及巨噬细胞的活化和增值，介导细胞毒性效应，在防御胞内病原体如胞内寄生菌、真菌、病毒感染时发挥了至关重要的作用。TH2细胞的主要功能是刺激B细胞增值，并产生抗体，参与体液免疫应答。TH2细胞可以释放IL-4 （D错）、IL-5（E错）、IL-6和IL-10的Th2细胞因子。IL-1（A错）主要由活化的单核-巨噬细胞产生。IL-3（C错）又称多能集落刺激因子，主要由活化的CD4⁺细胞产生。